健康危险度评价的资料是
A. 人群流行病学调查
B. 毒理学试验
C. 环境监测
D. 健康监护
E. 以上都是

正确答案：E。以上都是

解析：本题考查健康危险度评价的资料。健康危险度评价是按一定的准则，应用毒理学研究和流行病学调查等的资料系统科学地表征有害环境因素暴露对人类和生态的潜在损害作用，并对产生这种损害作用证据的强度或充分性进行评定，对危险性评估相关的不确定性进行评价。健康危险度评价的资料涉及到多个学科，包括人群流行病学调查、毒理学试验、环境监测和健康监护（E对ABCD错）等。